幼儿时生长素分泌不足可导致
A. 呆小症
B. 侏儒症
C. 巨人症
D. 向心性肥胖
E. 肢端肥大症

正确答案：B。侏儒症